口服可用于肠道感染的药物是
A. 庆大霉素
B. 链霉素
C. 奈替米星
D. 妥布霉素
E. 小诺米星

正确答案：A。庆大霉素

解析：本题考查庆大霉素。口服可用于肠道感染的药物是庆大霉素（A对）。庆大霉素为氨基糖苷类抗菌药，用于敏感革兰阴性杆菌所致的严重感染，包括肠道感染。链霉素（B错）主要用于抗结核病。奈替米星（C错）用于治疗敏感的肠杆菌科和其它需氧的革兰阴性杆菌引起的严重感染，以及除肠球菌外的某些庆大霉素耐药菌株所致感染。妥布霉素（D错）通常与一种抗绿脓杆菌青霉素、氨曲南或头孢他啶合用，治疗绿脓杆菌引起的各种感染。小诺米星（E错）抗菌作用与庆大霉素相似，且对细菌产生的乙酰转移酶稳定。